血小板减少可出现的临床表现是
A. 进行性贫血
B. 皮肤、鼻腔等处发生坏死性溃疡
C. 皮肤、黏膜出血
D. 频繁性呕吐
E. 胸骨压痛

正确答案：C。皮肤、黏膜出血

解析：血小板减少可出现皮肤、黏膜广泛出血（C对），脾大等症状。皮肤、鼻腔等处发生坏死性溃疡见于粒细胞缺乏症（B错）。进行性贫血见于慢性失血或溶血、白血病等（A错）。频繁性呕吐见于胃肠道疾病或颅内高压（D错）。胸骨压痛见于急性白血病等（E错）。